几乎能完全抑制创口收缩的皮片是
A. 表层皮片
B. 中厚皮片
C. 薄中厚皮片
D. 厚中厚皮片
E. 全厚皮片

正确答案：E。全厚皮片

解析：全厚皮片几乎能完全抑制创口收缩，而在断层皮肤移植中，创口收缩的程度与皮片厚度成反比。掌握“口外创口处理”知识点。